卫气营血证传变中属于逆传的是
A. 卫分到气分
B. 气分到血分
C. 血分到营分
D. 卫分到营血分
E. 气分到营血分

正确答案：D。卫分到营血分

解析：顺传是指温热病邪按照“卫分→气分→营分→血分”的次序传变（ABDE错），逆传是指温热病邪不按照该次序及规律传变，如邪入卫分后，不经过气分阶段而直接深入营分、血分，出现神昏、谵语等重笃病情（D对）。